小儿泄泻的好发年龄是
A. 2周岁以内
B. 2周岁～3周岁
C. 4周岁～6周岁
D. 7周岁～9周岁
E. 9周岁以上

正确答案：A。2周岁以内

解析：泄泻是以大便次数增多，粪质稀薄或如水样为特征，因婴幼儿脾常不足，易于感受外邪、伤于乳食或脾肾气阳亏虚，均可导致脾病湿盛（A对）。2周岁～3周岁已为幼儿期，其运化能力渐增强，发生泄泻几率减小（B错）。4周岁～6周岁已为学龄前期，易发生意外事故，脾系发病率降低（C错）。7周岁～9周岁为学龄期，应注意其心理变化，其儿童的发病率进一步下降（D错）。9周岁以上抗病能力日益增强（E错）。